下列有关坐骨神经的说法何者正确
A. 大多数经梨状肌上缘出骨盆
B. 大多数经梨状肌下缘出骨盆
C. 在臀大肌浅面沿坐骨结节与大转子之间下降
D. 在臀大肌深面沿坐骨结节与小转子之间下降
E. 在腘窝下方分成胫神经,腓总神经两个终支

正确答案：B。大多数经梨状肌下缘出骨盆

解析：坐骨神经从骶丛发出后，经梨状肌下孔出盆腔至臀大肌深面（A错B对），在坐骨结节与大转子连线的中点深面下行到达股后区（CD错），继而行于股二头肌长头的深面，一般在腘窝上方分为胫神经和腓总神经两大终支（E错）。